EGF是
A. 神经递质
B. 旁分泌的激素
C. 自分泌的激素
D. 细胞因子
E. 谷胱甘肽

正确答案：D。细胞因子